与口鼻腔相通或在口腔内手术的创口属于
A. 无菌创口
B. 污染创口
C. 感染创口
D. 一期愈合创口
E. 延期愈合创口

正确答案：B。污染创口

解析：本题考查口外创口处理。污染创口（B对）系指虽有细菌侵入，但尚未引起化脓性炎症的创口。在与口鼻腔相通或口腔内手术的创口，是在非无菌条件下进行的，故也属此类。